根据软药原理设计的超短效β受体拮抗剂，可用于室上性心律失常的紧急状态治疗的是
A. 盐酸索他洛尔
B. 阿替洛尔
C. 酒石酸美托洛尔
D. 艾司洛尔
E. 富马酸比索洛尔

正确答案：D。艾司洛尔

解析：本题考查艾司洛尔的药理作用及作用机制。艾司洛尔（D对）是根据软药原理得到的超短效的β₁受体拮抗剂，适用于室上性心律失常的紧急状态的治疗。